下列各穴中，属足太阴脾经的是
A. 大横
B. 章门
C. 期门
D. 梁门
E. 带脉

正确答案：A。大横

解析：该题考查足太阴脾经的腧穴。大横穴属于足太阴脾经，在脐正中旁开4寸（A对）。章门属足厥阴肝经（B错）。期门属足厥阴肝经（C错）。梁门属足阳明胃经（D错）。带脉属足少阳胆经（E错）。